未观察到损害作用水平（NOAEL）是指
A. 不引起亚临床改变或某项检测指标出现异常的最大染毒剂量或浓度
B. 引起DNA损伤的最低剂量
C. 引起免疫功能降低的最低剂量
D. 人类终生摄入该化学物不引起任何损害作用的剂量
E. 引起畸形的最低剂量

正确答案：A。不引起亚临床改变或某项检测指标出现异常的最大染毒剂量或浓度